直接参与Ⅰ型超敏反应的是
A. MΦ
B. T细胞
C. B细胞
D. NK细胞
E. 嗜碱性粒细胞

正确答案：E。嗜碱性粒细胞